患者女性，60岁舌左侧缘中部溃烂5个月，约2.3cm×1.5cm×0.5cm大小，活检报告为“鳞癌”，左下6残根，边缘锐利。舌癌转移的特点下列哪种说法是错误的
A. 舌癌常发生早期颈淋巴结转移，且转移率较高
B. 舌癌的颈淋巴结转移常在一侧
C. 发生于舌背或越过舌体中线的舌癌，可以向对侧颈淋巴结转移
D. 舌前部的癌多向下颌下及颈深淋巴结上、中群转移
E. 舌癌可发生远处转移，一般多为脑

正确答案：E。舌癌可发生远处转移，一般多为脑

解析：本题考查舌癌的转移。患者女性，60岁舌左侧缘中部溃烂5个月，约2.3cm×1.5cm×0.5cm大小，活检报告为“鳞癌”，左下6残根，边缘锐利，综合考虑为舌癌，舌癌转移的特点说法错误的是舌癌可发生远处转移，一般多为脑（E错，为本题正确答案）。舌癌可发生远处转移，一般多转移至肺部。舌癌常发生早期颈淋巴结转移，且转移率较高（A对），因舌体具有丰富的淋巴管和血液循环，加以舌的机械运动频繁，这些都是促使舌癌转移的因素。舌癌的颈淋巴结转移常在一侧（B对），如发生舌背或越过舌体中线的舌癌可以向对侧颈淋巴结转移（C对），位于舌侧缘的癌多向下颌下及颈深淋巴结转移；舌尖部癌可以转移至颏下或直接跳跃转移至颈深中群淋巴结（D对）。